使君子散治疗
A. 虫瘕证
B. 肠虫症
C. 蛔厥证
D. 蛲虫病
E. 绦虫病

正确答案：B。肠虫症

解析：使君子散具有驱蛔杀虫，调理脾胃的功效，故可用于肠虫证（B对）。虫瘕证应选用驱蛔承气汤（A错）。蛔厥证应选用乌梅丸加减（C错）。蛲虫病选用驱虫粉（D错）。对于绦虫病，绦虫踞肠者选用驱绦汤，囊虫移行选用囊虫丸（E错）。